患者，女，50岁，丧偶近1年，月经紊乱，现阴道流血3个月余，量时多时少，伴有烘热汗出，心烦不寐。应首选的治疗措施是
A. 药物止血
B. 激素替代疗法
C. 中医辨证治疗
D. 药物性刮宫
E. 诊断性刮宫

正确答案：E。诊断性刮宫

解析：诊断性刮宫，其作用是止血和明确子宫内膜病理诊断。对年龄超过35岁，药物治疗无效或存在子宫内膜癌高危因素的异常子宫出血患者，应通过诊刮明确子宫内膜病变。施术时必须搔刮整个宫腔，并注意宫腔大小、形态，宫壁是否光滑，刮出物性质及数量。为确定排卵和黄体功能，应在经前期或月经来潮6小时内诊刮；若怀疑子宫内膜不规则脱落，应在月经第5天诊刮；不规则阴道流血或大出血者可随时诊刮（E对）。